女性，38岁，最近两年因感觉丈夫有外遇而痛苦，经常悄悄跟踪及监视丈夫工作；与丈夫吵闹，请求丈夫的上司调离其身边所有女性同事；常感到丈夫表情不自然，每句话都是假的。这一症状属于
A. 被害妄想
B. 嫉妒妄想
C. 关系妄想
D. 钟情妄想
E. 焦虑症状

正确答案：B。嫉妒妄想